可用胰岛素治疗的疾病和控制症状有
A. 水盐代谢失调
B. 糖尿病
C. 甲状腺功能亢进症
D. 高血钾症
E. 细胞内缺钾

正确答案：B、D、E。糖尿病；高血钾症；细胞内缺钾

解析：本题考查胰岛素。可用胰岛素治疗的疾病和控制症状有糖尿病（B对）、高血钾症（D对）、细胞内缺钾（E对）。胰岛素能够控制高血糖，适用于2型糖尿病。胰岛素可促进细胞外钾离子和镁离子进入细胞内，维持细胞内环境的稳定，降低细胞外血钾浓度。水盐代谢代谢失调（A错）一般使用钠、钾、镁、钙等盐治疗。患甲状腺功能亢进（C错）者不能用胰岛素进行治疗。